下列不是“扳机点”在眼支的部位的是
A. 眶上孔
B. 鼻翼
C. 上眼睑
D. 眉
E. 前额

正确答案：B。鼻翼

解析：“扳机点”在眼支的部位是：眶上孔、上眼睑、眉、前额及颞部等。掌握“三叉神经痛”知识点。